女，1岁。于7月就诊。腹泻、呕吐3天，大便每日10余次，量中等，蛋花汤样，有黏液，霉臭味。查体：精神稍萎靡，皮肤弹性差，哭泪少。粪常规检查发现少量白细胞。最可能的病原体是
A. 致病性大肠埃希菌
B. 真菌
C. 铜绿假单胞菌
D. 轮状病毒
E. 痢疾杆菌

正确答案：A。致病性大肠埃希菌

解析：患儿，发生夏季腹泻，表现为蛋花样、有粘液、有臭味，导致腹泻的病原体为致病性大肠埃希菌（A对）。真菌性肠炎病程迁延，常伴鹅口疮。大便次数多，黄色稀便，泡沫较多带黏液，有时可见豆腐渣样细块（B错）。铜绿假单胞菌很少导致腹泻（C错）。轮状病毒发生腹泻时也为蛋花样，但是无臭味（D错）。痢疾杆菌为粘液脓血便且有里急后重的体征（E错）。